对Crohn病最有诊断意义的病理改变是
A. 肠腺隐窝脓肿
B. 炎性息肉
C. 肠瘘形成
D. 肠壁非干酪性上皮样肉芽肿
E. 肠系膜淋巴结肿大

正确答案：D。肠壁非干酪性上皮样肉芽肿

解析：Crohn病（克罗恩病）是一种慢性炎性肉芽肿性疾病，多见于末段回肠和临近结肠，其最有诊断意义的病理改变是非干酪性上皮样肉芽肿（D对）形成，肠瘘形成（C错）是Crohn病的特征性临床表现。肠腺隐窝脓肿（A错）是溃疡性结肠炎（八版内科学P386）的病理改变。炎性息肉（B错）和肠系膜淋巴结肿大（E错）不具有特异性。